龋病流行特征不包括
A. 地区分布
B. 时间分布
C. 人群分布
D. 氟化物分布
E. 城乡分布

正确答案：D。氟化物分布

解析：龋病的流行特征包括（一）地区分布（二）时间分布（三）人群分布1.年龄2.性别3.城、乡居民4.民族。掌握“龋病流行病学”知识点。